根管治疗中，根管消毒常用药物刺激性最强的为
A. 丁香油
B. FC
C. CP
D. 碘仿
E. 抗生素类药物

正确答案：B。FC

解析：甲醛甲酚（FC）是根管消毒剂中杀菌能力最强，刺激作用最大的一种药物，由于有细胞毒作用，所以一般用于髓腔封药，而不用根管内封药。掌握“根管清理与成形”知识点。